股静脉
A. 经腹股沟韧带前方
B. 临床上不作静脉穿刺
C. 有大、小隐静脉注入
D. 与内侧的股动脉伴行
E. 移行为髂外静脉

正确答案：E。移行为髂外静脉

解析：股静脉经腹股沟韧带后方（A错），续为髂外静脉（E对）。股静脉接受大隐静脉和与股动脉分支（C错）伴行的静脉。股静脉在腹股沟韧带的稍下方位于股动脉内侧（D错），临床上常在此处作静脉穿刺插管（B错）。